既能背屈又能使足内翻的肌是
A. 胫骨前肌
B. 胫骨后肌
C. （足母）长伸肌
D. 趾长伸肌
E. 腓骨长肌

正确答案：A。胫骨前肌

解析：胫骨前肌（A对）既能背屈（伸踝关节）又能使足内翻。胫骨后肌（B错）屈踝关节和使足内翻。（足母）长伸肌（C错）伸踝关节（背屈）和伸（足母）趾。趾长伸肌（D错）伸踝关节（背屈）和伸第2～5趾。腓骨长肌（E错）屈踝关节（跖屈）和使足外翻。